女性，30岁，左鼻翼下方肿物3年，检查见病变位于软组织内。切除肿物为囊性，囊壁内衬上皮为假复层柱状上皮，局部见复层鳞状上皮。囊壁结缔组织无明显炎症细胞。最可能的病理诊断是
A. 鼻腭囊肿
B. 鼻唇囊肿
C. 鼻腭管囊肿
D. 鳃裂囊肿
E. 球状上颌囊肿

正确答案：B。鼻唇囊肿

解析：本题考查鼻唇囊肿的诊断。患者左鼻翼下方肿物，囊性，囊壁内衬上皮为假复层柱状上皮，局部见复层鳞状上皮。综合考虑诊断为鼻唇囊肿（B对）。鼻唇囊肿是一种发生于牙槽突表面近鼻孔基部软组织内的囊肿，较少见。鼻腭囊肿（A错），又名鼻腭管囊肿（C错），衬里上皮变异较大，可内衬复层鳞状上皮、含黏液细胞的假复层纤毛柱状上皮、立方上皮或柱状上皮，这些上皮类型可单独或联合存在。鳃裂囊肿（D错）表现为球形或者半球形的囊肿，性质柔软，比较有弹性，通常高出于皮面，有移动性，境界比较清楚。球状上颌囊肿（E错）发生于上颌侧切牙和尖牙牙根之间。X线表现为边界清楚的梨形放射透光区，常导致相邻牙牙根的移位。以上均不符合本病例的临床表现，应诊断为鼻唇囊肿。